《中国人民共和国药品管理法实施条例》规定，个人设置的门诊部、诊所等医疗机构不得
A. 配备常用药品和急救药品以外的其他药品
B. 配备常用药品和急救药品
C. 配备中成药
D. 配备非处方药以外的药品
E. 使用中药饮片

正确答案：A。配备常用药品和急救药品以外的其他药品

解析：本题考查药品使用管理。个人设置的门诊部、诊所等医疗机构不得配备常用药品和急救药品以外的其他药品（A对）。